预防或治疗室性或室上性早搏和心动过速可选用的药物是
A. 普罗帕酮
B. 噻氯匹定
C. 洛伐他汀
D. 多巴酚丁胺
E. 米诺地尔

正确答案：A。普罗帕酮

解析：本题考查普罗帕酮。普罗帕酮（A对）属于Ⅰc类抗心律失常药，用于室性及室上性早搏、心动过速及预激综合征伴心动过速或心房纤颤者。噻氯匹定（B错）用于预防和治疗因血小板高聚集状态而引起的循环障碍。洛伐他汀（C错）为他汀类降脂药,能够使胆固醇的合成减少。多巴酚丁胺（D错）用于因器质性心脏病或心脏外科手术等引起的心力衰竭和休克等的短期支持治疗。米诺地尔（E错）可降低血压。